一贯煎和痛泻要方两方的治病机理均涉及
A. 滋水涵木
B. 扶土抑木
C. 培土生金
D. 清金制木
E. 补火生土

正确答案：B。扶土抑木

解析：一贯煎方中重用生地黄滋阴养血、补益肝肾为君，内寓滋水涵木之意。当归、枸杞养血滋阴柔肝；北沙参、麦冬滋养肺胃，养阴生津，意在佐金平木，扶土抑木，四药共为臣药。佐以少量川楝子，疏肝泄热，理气止痛，复其条达之性。痛泻要方之腹痛泄泻，其痛责之于肝，肝责之于实，其泻责之于脾，脾责之于虚，因此，方中使用白芍泻肝，白术健脾，防风散肝舒脾，即扶土抑木（B对）。